患者上颌前牙缺失，唇部失去支撑导致塌陷，则属于
A. 美观的影响
B. 咀嚼功能减退
C. 发音功能障碍
D. 颞下颌关节病变
E. 对牙周组织的影响

正确答案：A。美观的影响

解析：美观的影响：完整的牙列维持着面部的外貌。如前牙缺失，失去对唇部的支持，唇部、内陷，影响患者的美观。如上下牙列缺损，余留牙都无对颌牙接触，使面下1/3距离缩短，鼻唇沟加深，面部皱纹增加，面容显老。掌握“牙列缺损病因及影响”知识点。